女，80岁。高血压病史20年。间断头晕，既往有痛风史，查体：BP180/90mmHg，心率52次/分，律齐，心脏各瓣膜听诊区未闻及杂音。实验室检查，血肌酐100μmol/L.血钾正常，该患者的最适宜降压治疗方案是
A. 缬沙坦与美托洛尔
B. 氨氯地平与美托洛尔
C. 缬沙坦与氢氯噻嗪
D. 氨氯地平与氢氯噻嗪
E. 缬沙坦与氨氯地平

正确答案：E。缬沙坦与氨氯地平

解析：老年女性患者，BP180/90mmHg（正常值90～120mmHg/60～80mmHg），三级，心率52次/分（正常值60～80次/分），低缓。美托洛尔（AB错）是β受体拮抗剂，适用于心率较快的中、青年病人或合并心绞痛和慢性心力衰竭者，对老年高血压疗效相对较差，不适用于心动过缓的患者。氢氯噻嗪（CD错）是噻嗪类利尿药，适用于轻中度高血压，该患者为高血压三级，为重度，痛风患者禁用。缬沙坦（E对）是血管紧张素Ⅱ受体拮抗剂，降压作用起效缓慢，但持久而平稳，直接与药物有关的不良反应较少，适用于心脏收缩的高血压病人。氨氯地平（E对）是钙通道阻滞剂，降压起效迅速，降压疗效和幅度相对较强，适用于老年病人。